有关理想质粒载体的特点，正确的是
A. 为线性单链DNA
B. 含有多种限制酶的单一切点
C. 含有同一限制酶的多个切点
D. 其复制受宿主控制
E. 不含耐药基因

正确答案：B。含有多种限制酶的单一切点